以刺激性干咳或阵咳症状为主的患者宜选
A. 羟甲唑啉
B. 苯丙哌林
C. 克伦特罗
D. 羧甲司坦
E. 盐酸吗啡

正确答案：B。苯丙哌林

解析：本题考查镇咳药。以刺激性干咳或阵咳症状为主的患者宜选苯丙哌林（B对）。苯丙哌林是非麻醉性强效镇咳药，可抑制外周传入神经，亦可部分抑制咳嗽中枢，适用于刺激性干咳或剧烈阵咳。羟甲唑啉（A错）是α受体激动剂，用于鼻炎或鼻塞。克伦特罗（C错）是选择性β₂受体激动剂，用于支气管哮喘。羧甲司坦（D错）是黏痰调节剂，用于祛痰。盐酸吗啡（E错）有强大的中枢镇咳作用，对各种剧咳均有良效，但吗啡易成瘾，故临床上只选用成瘾性较低的可待因而不选择吗啡。